利用胶态过渡到液晶态，药物释放速度增大的原理制成的脂质体是
A. 热敏脂质体
B. 前体脂质体
C. 免疫脂质体
D. pH敏感脂质体
E. 长循环脂质体

正确答案：A。热敏脂质体

解析：本题考查新型靶向脂质体。利用在相变温度时，脂质体的类脂质双分子层膜从胶态过渡到液晶态，脂质膜的通透性增加，药物释放速度增大的原理制成热敏脂质体（A对）。